减压反射的生理意义是
A. 减弱心血管的活动
B. 降低动脉血压
C. 是动脉血压的负反馈调节
D. 是动脉血压的自身调节
E. 维持动脉血压相对稳定

正确答案：E。维持动脉血压相对稳定